肺毛细血管楔压（PCWP）的正常值是
A. 0.5～0.7kPa
B. 0.8～2.0kPa
C. 2.1～2.5kPa
D. 2.6～2.9kPa
E. 3.0～3.3kPa

正确答案：B。0.8～2.0kPa

解析：肺毛细管楔压能反映左室充盈压，可用作判断左心室功能。 失血性休克的病人，如果PCWP降低，则提示应补充血容量；心源性休克的病人，如果PCWP升高，提示左心衰竭或肺水肿。肺毛细管楔压（PCWP）正常值6～12mmHg（B对）。